第一恒磨牙在完全萌出后保护它的最佳方法是
A. 进行窝沟封闭
B. 含氟涂料
C. 牛奶氟化
D. 氟滴剂
E. 氟片

正确答案：A。进行窝沟封闭

解析：恒牙是人一生中的主要咀嚼器官，应终生保持牙列的完整和健康。尤其是第一恒磨牙在牙颌系统中占有非常重要的位置，是上下（牙合）关系的主要支柱，并承担最大的咀嚼功能。由于第一恒磨牙解剖生理结构特点，在萌出后2～4年非常容易发生龋坏，是儿童恒牙列中发生龋坏和因龋丧失最多的一颗牙。许多家长对6岁左右第一恒磨牙的萌出缺乏应有常识、关注不够，甚至不知道已经萌出，未能采取积极主动的保健措施，而使第一恒磨牙龋病高发，并贻误了最佳的治疗时期。龋坏如不及时治疗则会进一步发展成牙髓炎、根尖炎，甚至因龋丧失。因此，在小学时期应特别关注第一恒磨牙的健康，在完全萌出后的6个月内进行窝沟封闭是保护它的最佳方法。掌握“学龄儿童口腔保健”知识点。